患儿，男，4岁。一向偏食不吃鱼肉蛋，仅食蔬菜，近日面色渐苍白，不愿活动，时而腹泻，心肺正常，肝脏于肋下3cm触及，脾未及，血红蛋白60g/L，红细胞2.90×10¹²/L，血涂片示红细胞大小不等，以小细胞为主，中心淡染区扩大。最可能的诊断是
A. 溶血性贫血
B. 缺铁性贫血
C. 再生障碍性贫血
D. 巨幼红细胞性贫血
E. 营养性混合性贫血

正确答案：B。缺铁性贫血

解析：营养性缺铁性贫血临床表现具体为起病缓慢，皮肤黏膜逐渐苍白，以口唇和甲床等处明显，易疲乏，不爱活动；食欲减退，常有异食癖，可有呕吐、腹泻，或出现口腔炎、舌炎等；精神不振，注意力不集中，记忆力减退，严重出现智力减低等；年长儿可自诉头晕，眼前发黑等症状；明显贫血时心率增快，心脏扩大；易发生感染；肝、脾、淋巴结轻度肿大。外周血涂片可见红细胞大小不等，以小细胞为多，中央淡染区扩大。患儿一向偏食不吃鱼肉蛋，仅食蔬菜，而动物性食物（如精肉、血）含铁高且为血红素铁，吸收率达10%～25%，蔬菜中铁含量较少，提示铁摄取缺乏，结合患儿临床症状、体征及外周血涂片，考虑缺铁性贫血的可能性大（B对）。溶血性贫血（A错）的临床主要表现为可有异常家族史、贫血、黄疸、急性大量溶血表现（寒战、高热、头痛、腹痛及四肢痛，可伴有腹泻及呕吐、尿色深红等）及慢性溶血表现。再生障碍性贫血（C错）以贫血、出血、感染为特征。血常规表现为红细胞、粒细胞和血小板都明显减少。巨幼红细胞性贫血（D错）临床主要表现为贫血、神经精神症状、红细胞的胞体变大、骨髓中出现巨幼红细胞、用维生素B12或（和）叶酸治疗有效。营养性混合性贫血（E错）为铁性贫血和营养性巨幼细胞性贫血同时存在，临床表现为具有两类贫血的混合表现，往往以一种为主，另一种较轻，但一般均有一定程度的巨幼红细胞性贫血的表现。此类贫血的程度可很重，易出现全身性出血点。